慢性呼吸性碱中毒时血气分析参数的变化为
A. PaCO₂降低
B. SB、AB、BB均降低，AB<SB
C. BE负值增大
D. pH升高
E. 以上都是

正确答案：E。以上都是

解析：呼吸性碱中毒是指肺通气过度引起的PaC02降低（A对）、pH升高（D对），以血浆H2C03 浓度原发性减少为特征。慢性呼吸性碱中毒时，PaC02 的降低使肾小管上皮细胞代偿性泌H+泌NH3减少，而HC03-随尿排出却增多，因此血浆中HC03-代偿性降低,所以AB、SB及BB均降低，AB<SB（B对） ，BE负值加大（D对，故E为本题正确答案）。